低致吐性化疗药物所引起的恶心呕吐，宜选用的止吐治疗方案是
A. 化疗前联合使用昂丹司琼和地塞米松，化疗结束后给予2天的地塞米松或昂丹司琼
B. 化疗前后联合使用地塞米松和甲氧氯普胺
C. 化疗前联合使用昂丹司琼、地塞米松和阿瑞吡坦，化疗结束后给予2天的阿瑞吡坦和2～3天的地塞米松
D. 化疗前使用昂丹司琼，化疗后不需要继续使用止吐药
E. 化疗前使用阿瑞吡坦，化疗后需要继续使用止吐药

正确答案：D。化疗前使用昂丹司琼，化疗后不需要继续使用止吐药

解析：本题考查止吐药的选择。化疗前使用昂丹司琼，化疗后不需要继续使用止吐药（D对）为低致吐性化疗药所引起恶心呕吐，宜选用的止吐治疗方案。中致吐性化疗药物宜选用的止吐治疗方案是化疗前联合使用昂丹司琼和地塞米松，化疗结束后给予2天的地塞米松或昂丹司琼（A错）；高致吐性化疗药物宜选用的止吐治疗方案是化疗前联合使用昂丹司琼、地塞米松和阿瑞吡坦，化疗结束后给予2天的阿瑞吡坦和2～3天的地塞米松（C错）。